新小脑（皮质小脑）主要
A. 与身体平衡功能有关
B. 与调节肌紧张有关
C. 与调节随意运动有关
D. 与内脏运动有关
E. 与内脏感觉有关

正确答案：C。与调节随意运动有关